肝阳偏亢，肝风上扰，头痛，眩晕，失眠者，治疗应选用
A. 羚角钩藤汤
B. 天麻钩藤饮
C. 地黄饮子
D. 大定风珠
E. 镇肝熄风汤

正确答案：B。天麻钩藤饮

解析：本证系由肝肾不足，肝阳偏亢，生风化热所致。肝阳偏亢，风阳上扰，故头痛、眩晕；肝阳有余，化热扰心，故心神不安、失眠多梦。治以平肝息风，清热活血，补益肝肾的天麻钩藤饮（B对）。羚角钩藤汤（A错）的功用为凉肝息风，增液舒筋，主治肝热生风证。地黄饮子（C错）的功用为滋肾阴，补肾阳，开窍化痰，主治喑痱。大定风珠（D错）的功用为滋阴息风，主治阴虚风动证。镇肝熄风汤（E错）的功用为镇肝息风，滋阴潜阳，主治类中风。